医患关系中的“患”是指
A. 就诊病人
B. 病人亲属
C. 做体检的健康人
D. 到医院进行咨询的人
E. 以上都是

正确答案：E。以上都是